《灵枢·经脉》中“循咽喉，夹舌本”的经脉是
A. 手厥阴心包经
B. 足太阴脾经
C. 足厥阴肝经
D. 足少阴肾经
E. 足阳明胃经

正确答案：D。足少阴肾经

解析：足少阴肾经（D对）入肺中，循咽喉，夹舌本；足太阴脾经（B错）连舌本，散舌下。手厥阴心包经（A错）无明确联络的器官；足厥阴肝经（C错）联络的器官有：阴器、目系、唇；足阳明胃经（E错）联络的器官有：鼻子、上齿、口唇、耳、喉咙。